初产妇，30岁。妊娠38周，宫口大10cm，头先露，S+3，3小时后查胎心110次/分，最可能的诊断是
A. 活跃期停滞
B. 活跃期延长
C. 正常产程
D. 潜伏期延长
E. 第二产程延长

正确答案：E。第二产程延长

解析：初产妇，宫口大10cm（进入第二产程），头先露，S+3，3小时后查胎心110次/分，最可能的诊断是第二产程延长（E对）。正常分娩分为3个阶段：第一产程称宫颈扩张期，指从规律宫缩开始到宫颈口开全（10cm），分潜伏期和活跃期：潜伏期指从临产规律宫缩开始至活跃期起点(4～6cm） ，初产妇＞20 小时、经产妇＞14小时称为潜伏期延长（D错）；活跃期异常包括活跃期延长（B错）和活跃期停滞（A错）：前者为从活跃期起点至宫颈口开全，该阶段宫颈口扩张速度＜0.5cm/h即可确诊；后者为当破膜且宫颈口扩张＞6cm后，若宫缩正常，宫颈口停止扩张＞4小时；若宫缩欠佳，宫颈口停止扩张≥6小时确诊。第二产程称胎儿娩出期，指从宫口开全至胎儿娩出，该阶段若初产妇＞3小时，经产妇＞2小时而生产无进展，则为第二产程延长。第三产程为胎盘娩出期，即从胎儿娩出到胎盘娩出。本题给出时间为“3小时后”较不合理，但临床应按“第二产程延长”诊断及处理，以促进产程进展。